治疗高渗性脱水，理想的液体是
A. 5%碳酸氢纳液
B. 10%葡萄糖液
C. 0.9%氯化钠液
D. 0.45%氯化钠液
E. 平衡盐溶液

正确答案：D。0.45%氯化钠液

解析：高渗性脱水后补液应选用低渗液，补充已丧失的液体。0.45%氯化钠溶液（D对）为理想选择。5%碳酸氢纳液（A错）主要用于重症代谢性酸中毒（血浆HCO₃⁻低于10mmol/L或pH＜7.2）和高钾血症的治疗。10%葡萄糖液（B错）为高渗性溶液，会加重机体脱水。0.9%氯化钠液（C错）、平衡盐溶液（E错）为等渗液，主要用于治疗等渗性脱水。